问卷的一般结构包括
A. 封面信，指导语，问题和答案，计算机编码
B. 指导语，问题，答案，计算机编码
C. 封面信，指导语，问题和答案，备查项目
D. 封面信，指导语，问题，答案
E. 封面信，问题和答案，备查项目，审核记录

正确答案：A。封面信，指导语，问题和答案，计算机编码

解析：本题考查问卷的一般结构。问卷的一般结构包括封面信，指导语，问题和答案，计算机编码（A对BCDE错）。